社区口腔卫生服务的内容包括
A. 口腔健康教育
B. 口腔预防
C. 口腔医疗
D. 口腔保健
E. 以上均包括

正确答案：E。以上均包括

解析：本题考查社区口腔卫生服务。社区口腔卫生服务的内容从广义上讲，应包括各级卫生机构和社会相关部门为提高社区居民口腔健康状况而开展的一切活动，涉及口腔健康教育（A对）、口腔预防（B对）、口腔医疗（C对）、口腔保健（D对）、康复等初级口腔卫生保健的内容。因此，选E。